第Ⅱ相生物结合代谢中发生的反应有
A. 甲基化
B. 还原
C. 水解
D. 葡萄糖醛苷化
E. 形成硫酸酯

正确答案：A、D、E。甲基化；葡萄糖醛苷化；形成硫酸酯

解析：本题考查药物化学结构与第Ⅱ相生物转化的规律。第Ⅱ相生物转化最普遍的反应包括：1.与葡萄糖醛酸的结合反应（D对）、2.与硫酸的结合反应（E对）、3.与氨基酸的结合反应、4.与谷胱甘肽的结合反应、5.乙酰化结合反应、6.甲基化结合反应（A对）。水解反应（C错）和还原反应（B错）属于第Ⅰ相生物转化反应。